男，46岁，活动耐力进行性下降5年，近半年来平地行走50米左右即感呼吸急促，并出现双下肢水肿。1周前上呼吸道感染后症状加重，伴夜间阵发性呼吸困难。查体：平卧位，颈静脉怒张，肝颈静脉回流征阳性，双肺可闻及细湿啰音，双下肢凹陷性水肿。目前该患者的心衰类型为
A. 急性左心衰竭
B. 全心衰竭
C. 急性右心衰竭
D. 慢性右心衰竭
E. 慢性左心衰竭

正确答案：B。全心衰竭

解析：患者中年男性，活动耐力下降，夜间阵发性呼吸困难，双肺可闻及细湿啰音（左心衰竭导致肺循环淤血的典型表现），颈静脉怒张，肝颈静脉回流征阳性，双下肢凹陷性水肿（右心衰竭导致体循环淤血的典型表现），目前该患者的心衰类型为全心衰竭（B对DE错）。急性左心衰竭（A错）典型表现为突发严重呼吸困难，强迫坐位，频繁咳嗽，咳粉红色泡沫状痰。急性右心衰竭（P174）（C错）表现为体循环淤血，常见于右心室梗死、急性大面积肺栓塞和右心瓣膜病等。